下列关于破伤风的发病机制说法错误的是
A. 破伤风杆菌产生的内毒素引起症状
B. 痉挛毒素是引起症状的主要毒素
C. 溶血毒素引起组织局部坏死和心肌损害
D. 破伤风是一种毒血症
E. 毒素也可以影响交感神经

正确答案：A。破伤风杆菌产生的内毒素引起症状

解析：破伤风的发病机制是破伤风杆菌产生的外毒素引起的症状（A错，为本题正确答案）。外毒素有痉挛毒素和溶血毒素两种，引起症状的主要是痉挛毒素（B对）。痉挛毒素对神经有特殊的亲和力，能引起肌肉痉挛；溶血毒素能引起组织局部坏死和心肌缺血（C对）。毒血症是全身感染的一种类型，是指病原菌在侵入的局部组织中生长繁殖后，只有其产生的外毒素进入血循环，病原菌不入血。外毒素经血到达易感的组织和细胞，引起特殊的毒性症状，例如白喉、破伤风等（D对）。破伤风毒素还可阻断脊髓对交感神经的抑制，致使交感神经过度兴奋，引起血压升高、心率增快、体温升高、自汗等（E对）。